关于佐助药含义正确的是
A. 针对次要兼证起直接治疗作用的药
B. 针对兼病或兼证起主要治疗作用的药
C. 针对主病或者主证起主要治疗作用的药
D. 消减或制约君、臣药的毒性
E. 与君药性味或作用相反而又能在治疗中起相成作用的药物

正确答案：A。针对次要兼证起直接治疗作用的药

解析：方剂的组方原则即君臣佐使，佐药包括佐助药、佐制药和反佐药三种。其中，佐助药，即协助君、臣药以加强治疗作用，或直接治疗次要兼证的药物（A对）；制约君、臣药的峻烈之性，或减轻或消除君、臣药毒性的药物是佐药中的佐制药（D错）；根据某些病证之需，配伍少量与君药性味或作用相反而又能在治疗中起相成作用的药物，以防止药病格拒属于佐药中的反佐药（E错）；针对兼病或兼证起主要治疗作用的药属于臣药（B错）；针对主病或者主证起主要治疗作用的药属于君药（C错）。